生殖健康的定义是
A. 在生命所有各阶段的生殖功能和生命全过程中，身体、心理和社会适应的完好状态，而不仅仅是没有疾病和虚弱
B. 强调下列方面：①性生活方面：人们能享有负责、满意和安全的性生活，不必担心染上传染性疾病和计划外妊娠。②生育功能方面：根据自己意愿决定是否生育、何时生育及生育间隔。③母婴安全方面：妊娠及分娩经过安全、妊娠结局成功，婴儿存活并健康成长。④节育方面：夫妇能对节余方法进行选择，并获取安全、有效、易接受的方法
C. 内容广泛、以人为本对传统妇女保健观念的发展
D. 生殖道无病理表现，无异常体征
E. 行使正常生殖功能

正确答案：A。在生命所有各阶段的生殖功能和生命全过程中，身体、心理和社会适应的完好状态，而不仅仅是没有疾病和虚弱

解析：本题考查生殖健康的定义。WHO根据健康的定义给予生殖健康的定义为：在生命所有阶段的生殖功能和过程中的身体、心理和社会适应的完好状态，而不仅仅是没有疾病和虚弱（A对BCDE错）。